大豆磷脂在静脉注射脂肪乳剂中的作用是
A. 油相
B. 乳化剂
C. 等渗调节剂
D. pH调节剂
E. 抑菌剂

正确答案：B。乳化剂

解析：本题考查表面活性剂。静脉注射用脂肪乳处方分析：精制大豆油-油相（A错）；精制大豆磷脂-乳化剂（B对）；注射用甘油-等渗调节剂（C错）；注射用水-溶剂。此处方中无pH调节剂（D错）和抑菌剂（E错）。